降钙素分泌过多可产生
A. 低钙血症
B. 低磷血症
C. 两者均有
D. 两者均无
E. 无

正确答案：C。两者均有

解析：降钙素的生理作用为降低血钙和血磷，降钙素分泌过多可产生低钙血症（A对）和低磷血症（B对，故C为本题正确答案）。